仅仅甘油三酯（TG）升高，总胆固醇（TC）正常或轻度升高的病症是
A. Ⅰ型高脂蛋白血症
B. Ⅱa型高脂蛋白血症
C. Ⅱb型高脂蛋白血症
D. Ⅲ型高脂蛋白血症
E. Ⅳ型高脂蛋白血症

正确答案：A。Ⅰ型高脂蛋白血症